进入牙髓的细菌产生的有害物质不包括
A. 内毒素
B. 胶原酶
C. 淀粉酶
D. 透明质酸酶
E. 硫酸软骨素酶

正确答案：C。淀粉酶

解析：本题考查微生物因素的致病机制。淀粉酶是唾液腺产生的一种消化淀粉的消化酶，属于人体正常物质不是细菌的代谢产物（C错，为本题的正确答案）。进入牙髓的细菌产生的有害物质会引起牙髓的感染，主要的有害物质有内毒素（A对）、胶原酶（B对）、透明质酸酶（D对）和硫酸软骨素酶（E对）等。